女，35岁。腹泻、纳差、乏力、发热5月余。大便为黄色糊状，无粘液及脓血，3～5次/日，体温37.5～38℃。发病以来体重减轻约8kg。最可能的诊断是
A. 阿米巴肠病
B. 结肠癌
C. 溃疡性结肠炎
D. 肠结核
E. 克罗恩病

正确答案：D。肠结核

解析：该患者为中年女性，出现腹泻、纳差、乏力、发热5月余，大便为黄色糊状，，无粘液及脓血，并有体重下降，可初步诊断为肠结核（D对）。阿米巴肠病通常既往有相应的感染史，脓血便常见，大便常规可发现有关病原体（A错）。结肠癌通常见于41~65岁的中老年人，可出现排便习惯和粪便性状的改变，腹痛，查体可触及腹部坚硬肿块，结肠镜及病理活检可确诊（B错）。溃疡性结肠炎主要表现为腹痛，里急后重，排便后腹痛减轻，腹泻，排黏液脓血便，结肠镜可确诊（C错）。克罗恩病病程长，通常缓解和复发交替，可见瘘管、腹腔脓肿、肛周病变，结肠镜及病理活检可鉴别（E错）。